根据《药品说明书和标签管理规定》，应当注明执行标准的是
A. 注射剂的说明书
B. 原料药的标签
C. 药品包装内标签
D. 药品包装外标签
E. 药品最小包装标签

正确答案：B。原料药的标签

解析：本题考查药品标签的标识内容。根据《药品说明书和标签管理规定》，应当注明执行标准的是原料药的标签（B对）。药品标签的标识内容：《药品管理法》第四十九条规定，药品包装应当按照规定印有或者贴有标签并附有说明书。标签或者说明书应当注明药品的通用名称、成分、规格、上市许可持有人及其地址、生产企业及其地址、批准文号、产品批号、生产日期、有效期、适应症或者功能主治、用法、用量、禁忌、不良反应和注意事项。标签、说明书中的文字应当清晰，生产日期、有效期等事项应当显著标注，容易辨识。根据《药品说明书和标签管理规定》（局令第24号），药品包装标签的尺寸大小，对内标签、最小销售单元包装、大包装标签、中药饮片包装标签的内容做出不同规定。（1）药品内标签（C错）是指直接接触药品包装的标签。内包装标签可根据其尺寸的大小，应当尽可能包含药品通用名称、适应症或者功能主治、规格、用法用量、贮藏、生产日期、生产批号、有效期、生产企业等内容。包装尺寸过小无法全部标明上述内容的，至少应当标注药品通用名称、规格、产品批号、有效期等内容。（2）用于运输、储藏的包装的标签至少应当注明药品通用名称、规格、贮藏、生产日期、产品批号、有效期、批准文号、生产企业，也可以根据需要注明包装数量、运输注意事项或者其他标记等必要内容。对贮藏有特殊要求的药品，应当在标签的醒目位置注明。（3）原料药的标签应当注明药品名称、贮藏、生产日期、产品批号、有效期、执行标准、批准文号、生产企业，同时还需注明包装数量以及运输注意事项等必要内容。